出生半年后才能打的疫苗是
A. 乙肝
B. 卡介苗
C. 麻疹
D. 脊髓灰质炎
E. 白百破

正确答案：C。麻疹

解析：小儿出生时注射的疫苗是乙肝和卡介苗（AB错），百白破疫苗（E错）接种的时间为出生后第3个月、4个月、5个月。脊髓灰质炎（D错）疫苗接种的时间出生后2个月。麻疹（C对）疫苗接种的时间为出生后8个月和2岁时。